“气之本”的脏是
A. 心
B. 肺
C. 脾
D. 肾
E. 肝

正确答案：B。肺

解析：《素问·六节藏象论》：“心者，生之本（A错）（心主血脉、主藏神，主宰人体整个生命活动），神之变也…肺者，气之本（B对）（肺主一身之气），魄之处也…肾者，主蛰，封藏之本（D错），精之处也…肝者，罢极之本（E错）…魂之居也…脾胃大肠小肠三焦膀胱者，仓廪之本，营之居也”。人体生命过程的维持及其所需精气血津液等营养物质的产生，均依赖于脾（胃）运化所化生的水谷精微，故又称脾（胃）为“后天之本”、“气血生化之源”（C错）。